患者，男，于拔牙3周后就诊，要求行固定义齿修复，应嘱其就诊时间为
A. 1周
B. 4周
C. 6周
D. 9周
E. 12周

正确答案：D。9周

解析：本题考查固定义齿修复的时间。患者，男，于拔牙3周后就诊，要求行固定义齿修复，应嘱其就诊时间为9周（D对）。缺牙区的牙槽嵴在拔牙或手术后3个月完全愈合，牙槽嵴的吸收趋于稳定，可以行固定义齿修复。因此患者在拔牙后3周来就诊，所以应嘱其就诊时间为9周。